女，42岁。10年前分娩后闭经。1周前因不洁饮食出现腹泻，食欲减退，精神萎靡，卧床不起，今日上午被家人发现神志不清来急诊查体：BP80/50mmHg，皮肤苍白，毛发稀疏，消瘦，心率90次/分，血糖2.4mmol/L，胸部X线检查示“左上肺陈旧性结核”。应了解的最重要的既往史是
A. 胃肠道疾病史
B. 糖尿病史
C. 分娩出血史
D. 结核病史
E. 进食异常

正确答案：C。分娩出血史

解析：患者为中年妇女，10年前分娩后闭经（怀疑为希恩综合征，其常见表现为闭经），1周前因不洁饮食出现腹泻，食欲减退，精神萎靡等症状。查体：BP80/50mmHg（低于正常血压90/60mmHg），皮肤苍白，毛发稀疏，消瘦等症状（希恩综合征表现为闭经、无泌乳、性欲减退、毛发脱落等，第二性征衰退，生殖器官萎缩，以及肾上腺皮质、甲状腺功能减退，出现畏寒、嗜睡、低血压）。血糖2.4mmol/L（＜2.8mmol/L，为低血糖。患者1周前因不洁饮食出现腹泻，引起肾上腺危象，表现为血压降低、心率快、常有低血糖症），应首先考虑希恩综合征。希恩综合征是由于产后大出血休克所致腺垂体促性腺激素分泌细胞缺血坏死，而引起腺垂体功能低下而出现一系列症状，故应该了解患者的分娩出血史（C对），根据出血多少进行判断。但胃肠道疾病史（A错）、糖尿病史（B错）、结核病史（D错）以及进食异常（E错）均不会出现分娩后闭经，对于诊断希恩综合征意义不大。